某社区年均人口为9万，年内共死亡150人，其中60岁以上死亡100人；在全部死亡者中，因肿瘤死亡人数为50人，该社区年内共出生100人。该社区年度总死亡率为
A. 0.56‰
B. 1.66‰
C. 0.33‰
D. 1.11‰
E. 0.3333

正确答案：B。1.66‰

解析：本题考查总死亡率的计算。死亡率表示在一定期间内，某人群中总死亡人数在该人群中所占的比例。计算时分子为某人群某年总死亡人数，分母为该人群平均人口数，可得出该社区年度总死亡率为150/9万＝1.66‰（B对ACDE错）。